对判断白细胞分布异常最有意义的检查是
A. 骨髓造血干细胞培养
B. 肾上腺素试验
C. 骨髓细胞学检查
D. 白细胞聚集试验
E. 氢化可的松试验

正确答案：B。肾上腺素试验

解析：成熟的中性粒细胞多贮存在骨髓中（骨髓贮备池），可随时释放入血，中性粒细胞至血液后，约一半附着于小血管壁，称为边缘池，另一半在血液循环中，称为循环池（P562），中性粒细胞在边缘池和循环池中的比例异常称为白细胞分布异常。肾上腺素试验（B对）也称粒细胞边缘池功能检测，白细胞分布异常时，粒细胞过多的聚集在边缘池，肾上腺素可刺激边缘池中过多的粒细胞释放入循环池，导致血常规中性粒细胞计数明显升高，故肾上腺素试验对白细胞分布异常有重要意义。骨髓干细胞培养（A错）主要用于了解造血干细胞、造血微环境、造血调节因子等有无缺陷；骨髓细胞学检查（P534）（C错）对某些血液病有确诊价值（如白血病、骨髓瘤、骨髓纤维化等）及参考价值，但不能判断白细胞分布异常；白细胞聚集试验（P563）（D错）主要用于判断是否存在抗粒细胞自身抗体；氢化可的松试验（E错）主要用于了解骨髓贮备粒细胞的量及释放功能。